称量时的读数为0.0520g，其有效数字的位数为
A. 5位
B. 4位
C. 3位
D. 2位
E. 1位

正确答案：C。3位